衣服面料中对健康的危害最小的是
A. 染料
B. 染整助剂
C. 纤维强度
D. 农药残留
E. 甲醛残留

正确答案：C。纤维强度

解析：本题考查对健康的危害最小的衣服面料。衣服面料中对健康的危害最小的是纤维强度（C对ABDE错）。纤维强度是指纤维拉断时所能承受的最大负荷。